器官形成期这一阶段对致畸作用的敏感性最强，受到环境有害因素的影响，易于发生先天性畸形。人体主要器官系统的形成期是受精后第几周
A. 1～3
B. 3～8
C. 5～8
D. 4～10
E. 5～10

正确答案：B。3～8